与气逆证相关的脏腑是
A. 肺脾胃
B. 肺脾肝
C. 肺胃肝
D. 脾胃肝
E. 肺脾肾

正确答案：C。肺胃肝

解析：气逆最常见于肺、胃、肝三个脏腑（C对）。在肺，则肺失肃降，肺气上逆，发为咳逆上气；在胃，则胃失和降，胃气上逆，发为嗳气、恶心、呕吐等；在肝，则肝气上逆，发为头痛头胀等。脾会出现气虚证、气陷证、气脱证，但脾不会引起气逆证（ABDE错）。